临床上，治疗药物检测常用的生物样品是
A. 全血
B. 血浆
C. 唾液
D. 尿液
E. 粪便

正确答案：B。血浆

解析：本题考查体内药物检测。临床上，治疗药物检测常用的生物样品是血浆（B对）。血药浓度系指药物吸收后在血浆内的总浓度，包括与血浆蛋白结合的或在血浆游离的药物，与给药剂量、给药途径(口服、舌下、吸入、注射)、给药次数以及时间有关。血浆中药物的浓度能够反映药物在靶器官的状况，因而，血浆药物浓度可作为体内药物浓度的可靠指标。全血（A错）只有在特别说明的少数情况下使用。唾液（C错）不一定与药物浓度有相关性，取决于药物使用部位。尿液（D错）中的药物浓度变化较大，只在特定情况下作为检测样本。